既是疾病过程中的病理产物，又是某些疾病致病因素的是
A. 六淫
B. 过逸
C. 七情
D. 痰饮、瘀血
E. 疠气

正确答案：D。痰饮、瘀血

解析：痰饮、瘀血是疾病过程中形成的病理产物，又能作用于人体，干扰正常身体机能，加重病理变化，因此也是一种致病因素（D对）。六淫（A错）多属于外感病邪。过逸（B错）属于劳逸失度，为内伤。七情（C错）多发为情志病，属内伤。疠气（E错）属于现代疾病中的烈性传染病。